癃闭辨证应首先辨
A. 寒热
B. 虚实
C. 脏腑
D. 表里
E. 阴阳

正确答案：B。虚实

解析：癃闭辨证首先要判别病之虚实，故选虚实（B对）。